静脉角的组成
A. 左、右头臂静脉
B. 颈内静脉和颈外静脉
C. 颈外静脉和锁骨下静脉
D. 锁骨下静脉和颈内静脉
E. 无

正确答案：D。锁骨下静脉和颈内静脉

解析：锁骨下静脉和颈内静脉（D对）两条静脉的会合处形成静脉角，是淋巴导管注入的部位。